与咬肌前缘相对应的解剖结构是
A. 远中颊角区
B. 翼下颌韧带
C. 颊系带
D. 下颌骨外斜嵴
E. 磨牙后垫

正确答案：A。远中颊角区

解析：本题考查无牙颌的解剖标志-远中颊角区。与咬肌前缘相对应的解剖结构是远中颊角区（A对）。远中颊角区位于咬肌前缘颊侧翼缘区的后方。翼下颌韧带位于颊肌与咽上缩肌之间（B错）。颊系带位于前磨牙牙根部（C错）。下颌骨外斜嵴即外斜线，是从颏结节经颏孔之下向后上延至下颌支前缘的骨嵴（D错）。磨牙后垫位于下颌最后磨牙牙槽嵴的远端（E错）。